SARS的首发症状多为
A. 发热
B. 咳嗽
C. 头痛
D. 呕吐
E. 乏力

正确答案：A。发热

解析：病初的1-7日。起病急，以发热为首发症状（A对），体温一般大于38℃，可伴有头痛、肌肉及关节酸痛、乏力等；部分患者可有干咳、胸痛、腹泻等症状；常无上呼吸道卡他症状。发病3～7日后出现下呼吸道症状，多为干咳、少痰，偶有血丝痰；可有胸闷，肺部体征不明显。